山药具有的功效是
A. 补肾固精
B. 养血安神
C. 补气升阳
D. 益卫固表
E. 补脾祛湿

正确答案：A。补肾固精

解析：该题考查山药的功效，属记忆内容。山药味甘，性平；入脾、肺、肾经；具有益气养阴，补脾肺肾，固精止带的功效（A对BCDE错）。